用开水浸泡，表面有黏性，加热煮至种皮破裂时露出白色卷旋状胚的中药材是
A. 菟丝子
B. 葶苈子
C. 沙苑子
D. 女贞子
E. 牵牛子

正确答案：A。菟丝子